2017年初，某医院召开药事管理与药物治疗学委员会会议和抗菌药物管理工作组审议会议。会议通报了医院合理用药情况，拟定了2017年全院抗菌药物专项整治工作方案，并对院内抗菌药物品种遴选、采购、清退、更换等事宜进行表决。如果该医院采购的某抗菌药物品种存在性价比差，且经常出现超适应症，超剂量使用等违规使用情况，相关部门提出清退意见，对抗菌药物清退的说法，正确的是
A. 抗菌药物清退意见只能由抗菌药物管理工作组提出
B. 清退品种或者品规原则上不得重新进入本机构抗菌药物供应目录
C. 清退意见经抗菌药物管理工作组二分之一以上成员同意后执行，并报药事管理与药物治疗学委员会备案
D. 清退意见经药事管理与药物治疗学委员会讨论通过后执行

正确答案：C。清退意见经抗菌药物管理工作组二分之一以上成员同意后执行，并报药事管理与药物治疗学委员会备案

解析：本题考查的是抗菌药物遴选和定期评估制度。2017年初，某医院召开药事管理与药物治疗学委员会会议和抗菌药物管理工作组审议会议。会议通报了医院合理用药情况，拟定了2017年全院抗菌药物专项整治工作方案，并对院内抗菌药物品种遴选、采购、清退、更换等事宜进行表决。如果该医院采购的某抗菌药物品种存在性价比差，且经常出现超适应症，超剂量使用等违规使用情况，相关部门提出清退意见，对抗菌药物清退的说法，正确的是清退意见经抗菌药物管理工作组二分之一以上成员同意后执行，并报药事管理与药物治疗学委员会备案（C对）。抗菌药物遴选和定期评估制度：医疗机构遴选和新引进抗菌药物品种，应当由临床科室提交申请报告，经药学部门提出意见后，由抗菌药物管理工作组审议。抗菌药物管理工作组三分之二以上成员审议同意，并经药事管理与药物治疗学委员会三分之二以上委员审核同意后方可列入采购供应目录。抗菌药物品种或者品规存在安全隐患、疗效不确定、耐药率高、性价比差或者违规使用等情况的，临床科室、药学部门、抗菌药物管理工作组可以提出清退或者更换意见（A错）。清退意见经抗菌药物管理工作组二分之一以上成员同意后执行（D错），并报药事管理与药物治疗学委员会备案，更换意见经药事管理与药物治疗学委员会讨论通过后执行。清退或者更换的抗菌药物品种或者品规原则上12个月内不得重新进入本医疗机构抗菌药物供应目录（B错）。